病人朝食暮吐，暮食朝吐，最宜诊断为
A. 胃反
B. 霍乱
C. 呃逆
D. 气逆
E. 嗳气

正确答案：A。胃反

解析：朝食暮吐、暮食朝吐者，为胃反，多属脾胃阳虚证（A对）。霍乱临床特征为剧烈腹泻、呕吐、大量米泔样排泄物、水电解质紊乱和周围循环衰竭，严重休克者可并发急性肾功能衰竭（B错）。呃逆是指从咽喉发出的一种不由自主的冲击声，呃呃作响，声短而频，不能自制的症状（C错）。气逆证的辨证依据是，以咳喘或呕吐、呃逆等为突出表现（D错）。嗳气是指胃中气体上出咽喉所发出的一种声长而缓的症状（E错）。